决定刺激性气体的作用部位和病变程度的因素是
A. 化学物结构
B. 化学物物理特性
C. 化学物的溶解度
D. 化学物的浓度
E. 化学物的溶解度和浓度

正确答案：E。化学物的溶解度和浓度